关于持久性有机污染物POP特征，不正确的是
A. 持久性
B. 蓄积性
C. 迁移性
D. 高毒性
E. 易溶性

正确答案：E。易溶性

解析：本题考查持久性有机污染物的特征。持久性有机污染物是指能持久存在环境中，并可借助大气、水、生物体等环境介质进行远距离迁移，通过食物链富集，对环境和人类健康造成严重危害的天然或人工合成的有机污染物质。其特征具有：持久性（A对）、生物蓄积性（B对）、迁移性（C对）、高毒性（D对）。持久性有机污染物不具有易溶性（E错，为本题正确答案）。